体内嘧啶核苷酸合成的原料是
A. 甘氨酸﹢氨基甲酰磷酸﹢PRPP
B. 谷氨酸﹢氨基甲酰磷酸﹢PRPP
C. 谷氨酰胺﹢氨基甲酰磷酸﹢PRPP
D. 天冬氨酸﹢氨基甲酰磷酸﹢PRPP
E. 精氨酸﹢氨基甲酰磷酸﹢PRPP

正确答案：D。天冬氨酸﹢氨基甲酰磷酸﹢PRPP